以下哪项是心脑血管病的主要病理学基础
A. 骨质疏松
B. 血小板减少
C. 白细胞升高
D. 动脉粥样硬化
E. 癌症

正确答案：D。动脉粥样硬化

解析：动脉粥样硬化是心脑血管病的主要病理学基础，防治动脉粥样硬化是防治心脑血管病的重要措施。掌握“抗动脉粥样硬化药”知识点。